X线检查有
A. 常规X线根尖片
B. X线曲面断层片
C. 颞下颌关节X线侧位片
D. 头颅定位片
E. 以上都对

正确答案：E。以上都对

解析：X线检查包括：常规X线根尖片、X线曲面断层片、颞下颌关节X线侧位片、头颅定位片，锥形束CT（CBCT）等。掌握“修复学临床检查”知识点。